氯化物检查法中，50ml供试液中氯化物浓度为
A. 10～30㎍
B. 50～80㎍
C. 80～100㎍
D. 100～120㎍
E. 100～200㎍

正确答案：B。50～80㎍